以下说法错误的是
A. 甲型肝炎的发病有周期性起伏现象
B. 人群无论年龄大小对HBV普遍易感
C. HBsAg携带者不能献血以及从事保育工作
D. 乙型肝炎和丙型肝炎都有家庭聚集现象
E. 对易感者接种丁肝疫苗，乙型肝炎的感染也会随之减少

正确答案：E。对易感者接种丁肝疫苗，乙型肝炎的感染也会随之减少